哺乳动物长期致癌试验结果分析指标是
A. 肿瘤发生率，肿瘤多发性，肿瘤潜伏期
B. 肿瘤发生率，肿瘤多发性，肿瘤死亡率
C. 肿瘤多发性，肿瘤潜伏期，肿瘤死亡率
D. 肿瘤发生率，肿瘤存活率，肿瘤死亡率

正确答案：A。肿瘤发生率，肿瘤多发性，肿瘤潜伏期

解析：本题考查哺乳动物长期致癌试验结果分析指标。哺乳动物长期致癌试验是确认动物致癌物较为可靠的方法。其结果分析指标有：1.肿瘤发生率：肿瘤发生率是最重要的指标，需要计算肿瘤（良性和恶性）总发生率、恶性肿瘤总发生率、各器官或组织肿瘤发生率和恶性肿瘤发生率，以及各种病理类型肿瘤发生率；2.多发性：肿瘤的多发性是化学致癌的显著特征。多发性是指一只动物出现多种器官肿瘤或一个器官出现多个肿瘤；3.潜伏期：从接触致癌物到各组出现第一个肿瘤的时间作为该组的潜伏期。这种办法只适用于能在体表观察的肿瘤，如皮肤肿瘤或乳腺肿瘤（A对BCD错）。